上市后的药品临床再评价阶段属于
A. Ⅰ期临床试验
B. Ⅱa期临床试验
C. Ⅲ期临床试验
D. Ⅳ期临床试验
E. Ⅱb期临床试验

正确答案：D。Ⅳ期临床试验

解析：本题考查新药临床评价的分期。上市后药物临床再评价阶段是Ⅳ期临床试验（D对）。Ⅰ期临床试验（A错）是初步的临床药理学及人体安全性评价试验阶段。Ⅱ期临床试验（BE错）是治疗作用的初步评价阶段，评价药物对目标适应证患者的治疗作用和安全性。Ⅲ期临床试验（C错）是新药得到批准试生产后进行的扩大化临床试验阶段，进一步验证药物对目标适应证患者的治疗作用和安全性。